采用正态近似法估计总体率的置信区间，一般要求
A. n≥50
B. p不接近0
C. p接近0.50
D. np或n（1﹣p）大于5
E. n足够大，且np与n（1﹣p）均大于5

正确答案：E。n足够大，且np与n（1﹣p）均大于5